患者心下痞满，恶心呕吐，肠鸣，便溏，舌质稍淡，舌苔淡黄而厚腻，脉滑，治宜
A. 生姜泻心汤
B. 大黄黄连泻心汤
C. 五苓散
D. 半夏泻心汤
E. 桂枝人参汤

正确答案：D。半夏泻心汤

解析：伤寒五六日，出现“呕而发热”者，是外邪已入少阳，医者不识。以他药误下，可出现三种转归：①柴胡证仍在，说明未因误下而变生他证，故曰“此虽已下之，不为逆”，仍可与柴胡汤。服柴胡汤后，正气得药力之助而奋起抗邪，可出现“蒸蒸而振，却发热汗出而解”的战汗。②误下后邪热内陷，与水饮互结，则形成心下满而硬痛的大结胸证。③误下后损伤脾胃之气，邪气乘机内陷，致寒热错杂于中，脾胃升降失常，气机痞塞，形成心下痞，治当辛开苦降，和胃消痞，宜半夏泻心汤。“但满而不痛”，是痞证的辨证要点。由于本条之心下痞是由寒热之邪痞塞中焦，脾胃升降失和所致，故当兼见恶心、呕吐等胃气不降之证，及肠鸣、下利等脾气不升之证。该患者心下痞满且不痛，结合其他证候，诊为半夏泻心汤证（D对）。